“夫医者，非仁爱之士不可托也；非聪明理达不可任也；非廉洁淳良不可信也。”此语出自
A. 晋代杨泉
B. 唐代孙思邈
C. 宋代林逋
D. 明代陈实功
E. 清代王清任

正确答案：A。晋代杨泉

解析：“夫医者，非仁爱之士不可托也；非聪明理达不可任也；非廉洁淳良不可信也。”这句名言是晋代杨泉（A对）提出的。